细辛的主治病证不包括
A. 风寒表证
B. 阳虚外感
C. 风寒湿痹
D. 头风头痛
E. 肺热喘咳

正确答案：E。肺热喘咳

解析：本题考查的是细辛的主治病证。细辛的主治病证不包括肺热喘咳（E错，为本题正确答案）。细辛：【主治病证】【主治病证】（1）风寒表证（A对）（尤宜鼻塞、头痛、肢体疼痛较甚者），阳虚外感（B对）。（2）鼻渊头痛。（3）头风头痛（D对），牙痛，风寒湿痹（C对）痛。（4）寒饮咳喘。肺热咳喘为石膏的主治病证。石膏：【主治病证】（1）温病气分高热。（2）肺热咳喘。（3）胃火上炎所致的头痛、牙龈肿痛、口舌生疮。（4）疮疡不敛，湿疹，水火烫伤，外伤出血。